青霉素G治疗何种疾病时可引起赫氏反应
A. 大叶性肺炎
B. 梅毒或钩端螺旋体病
C. 草绿色链球菌心内膜炎
D. 回归热
E. 破伤风

正确答案：B。梅毒或钩端螺旋体病

解析：赫氏反应：青霉素治疗梅毒、钩端螺旋体、雅司、鼠咬热和炭疽时，可有症状加剧现象，出现寒战、发热、肌肉疼痛、心跳加快等症状（B对）。